男，50岁，1周前心前区剧烈疼痛，随后心悸气促，怀疑急性心肌梗死。为确诊最有帮助的酶学检查是
A. LDH
B. GOT
C. CPK
D. 肌钙蛋白T
E. CPK同工酶

正确答案：D。肌钙蛋白T

解析：肌钙蛋白T（cTnT）（D对）是诊断急性心肌梗死的确定性标记物，其诊断特异性为74%～96%，灵敏度为50%～59%。肌酸激酶（CK）也称为肌酸磷酸激酶（CPK）（九版诊断学P388），CK-MB（属于CPK同工酶）对急性心肌梗死的诊断不如肌钙蛋白T，但对早期（＜4小时）诊断有较重要价值（E错）。LDH（A错）即乳酸脱氢酶、GOT（B错）即天冬氨酸氨基转移酶（AST）、CPK（C错）即肌酸激酶（CK），三者由于特异性及敏感性均远不如肌钙蛋白T和CK-MB等心肌坏死标记物，已不再用于诊断AMI。